耳屏前，下颌骨髁状突后缘的腧穴是
A. 下关
B. 听宫
C. 听会
D. 耳门
E. 颧髎

正确答案：B。听宫

解析：下关为足阳明胃经腧穴，位于耳屏前，下颌骨髁状突前方，当颧弓与下颌切迹所形成的凹陷中。合口有孔，张口即闭，宜闭口取穴（A错）。听宫为手太阳小肠经腧穴，位于耳屏前，下颌骨髁状突的后方，张口时呈凹陷处（B对）。听会为足少阳胆经腧穴，位于耳屏切迹前，下颌骨髁状突后缘，张口凹陷处（C错）。耳门为手少阳三焦经腧穴，位于耳屏上切迹前，下颌骨髁状突后缘，张口有凹陷处（D错）。颧髎为手太阳小肠经腧穴，位于目外眦直下，颧骨下缘凹陷处（E错）。